关于化妆品不正确的说法是
A. 具美容作用的物品就是化妆品
B. 化妆品都是外用的
C. 化妆品可应用于不同年龄的人群
D. 洗面奶属于化妆品
E. 牙膏属于化妆品

正确答案：A。具美容作用的物品就是化妆品

解析：本题考查化妆品的判别。化妆品是指以涂擦、喷洒或其他类似方法，散布于人体表面（皮肤、毛发、指甲、口唇等）、牙齿以及口腔黏膜，以清洁、保护、美化、修饰以及保持其处于良好状态为目的的产品。凡内服或经呼吸道吸入方式进入人体的药品，即使有美容作用也不属化妆品（A错，为本题正确答案）。化妆品一般都是外用的（B对），可应用于不同年龄的人群（C对）。洗面奶（D对）、牙膏（E对）都属于化妆品。